患者，女，27岁，孕32周，4天前受凉后开始持续发热，体温最高达39.5℃，伴咽痛、声音嘶哑。查体：扁桃体Ⅲ度肿大，咽部表面有脓点。患者否认药物过敏史。该患者宜选用的退热药物是
A. 布洛芬
B. 双氯芬酸
C. 塞来昔布
D. 阿司匹林
E. 对乙酰氨基酚

正确答案：E。对乙酰氨基酚

解析：本题考查发热的药物治疗。对乙酰氨基酚（E对）对中枢神经系统前列腺素合成的抑制作用比对外周前列腺素合成的抑制作用强，解热作用强，镇痛作用较弱，但作用缓和而持久，对胃肠道刺激小，正常剂量下较为安全有效，是首选的退热药，通常认为在妊娠期，对乙酰氨基酚可在正常剂量范围内短期使用，但不推荐长期大剂量使用，因该药长期使用的安全性证据还不充分。